男，78岁。间断餐后上腹痛伴嗳气40年，无反酸，曾行胃镜及病理检查提示重度萎缩性胃炎。近期出现乏力及消瘦。胃镜发现胃角巨大溃疡，周边不规则隆起，中心有较大血凝块附着，其余部位无出血病变。行手术治疗。术后病理最可能为
A. 胃淋巴瘤
B. 胃间质瘤
C. 胃癌
D. 胃溃疡
E. 胃结核

正确答案：C。胃癌

解析：老年男性患者，既往有餐后上腹痛伴嗳气病史40年，胃镜提示重度萎缩性胃炎（提示有癌变的可能），近期出现乏力及消瘦（恶病质体征）。胃镜检查：胃角巨大溃疡，周边不规则隆起（胃癌镜下变化）。综合该患者的病史、临床表现及胃镜检查，考虑诊断为胃癌（C对）。胃淋巴瘤（九版外科学P350）（A错）指原发于胃而起源于黏膜下层淋巴组织的肿瘤，胃镜检查可见黏膜隆起、溃疡、粗大肥厚的皱襞呈卵石样改变、黏膜下多发结节或肿块等。胃间质瘤（九版外科学P351）（B错）境界清楚，无包膜，向腔内生长呈息肉样肿块常伴发溃疡形成。胃溃疡（P359）（D错）直径＜10mm，边缘光整，底部由肉芽组织构成，覆以灰黄色渗出物，周围黏膜常有炎症水肿。胃结核（E错）常有结核病史，伴全身结核中毒症状。